原发性疱疹性龈口炎病程为
A. 2～5天
B. 4～6天
C. 7～8天
D. 9～11天
E. 9～13天

正确答案：C。7～8天

解析：本题考查原发性疱疹性龈口炎的病程。原发性疱疹性龈口炎为最常见的由型单纯疱疹病毒引起的口腔病损。本病以6岁以下儿童较多见，尤其是6个月至2岁更多。根据本病的临床表现可以分为四个时期：前驱期通常为4～7天以后出现发热、疲乏不适、头痛。水疱期口腔粘膜任何部位皆可发生簇集状小水疱，似针头大小。糜烂期小水疱溃破后可引起大面积的溃疡。愈合期糜烂面逐渐缩小、愈合，整个病程约需7～10天（C对）。